贫血性梗死主要发生于
A. 心、肝、肾
B. 心、肺、脾
C. 心、肾、脾
D. 大脑、肺、肾
E. 小肠、肝、心

正确答案：C。心、肾、脾

解析：根据梗死灶内的含血量多少，可将梗死分为贫血性梗死、出血性梗死和败血性梗死。其中贫血性梗死主要发生于组织结构较致密、侧枝循环不充分的实质器官，如心、肾、脾（C对）等；出血性梗死（P59）主要发生于组织疏松，有双重血液循环的器官伴有严重淤血时，如肺、肠、卵巢等；败血性梗死（P59）常见于急性感染性心内膜炎。